关于流感病毒的特点，哪项错误
A. 是有包膜病毒
B. 具有神经氨酸酶（NA）刺突
C. 不易发生抗原性变异
D. 具有分节段的RNA和核蛋白（NP）
E. 具有血凝素HA刺突

正确答案：C。不易发生抗原性变异